阴偏盛所致的证候是
A. 实热证
B. 虚热证
C. 实寒证
D. 虚寒证
E. 寒热错杂证

正确答案：C。实寒证

解析：形成阴偏胜的主要原因，多由于感受寒湿阴邪，或过食冷，或阴寒性病理产物积聚，寒邪中阻等，导致阴邪亢盛。阴邪亢盛，以寒、静、湿为其临床特点，可见形寒肢冷，跪卧，舌淡而润，脉迟等（C对）。阴邪亢盛，阴长阳消，“阴胜则阳病”，可损伤阳气。阴盛之初，对阳气损伤不明显，从而出现实寒证。如果阴寒内盛较重，多伤及阳气，故常同时伴有程度不同的阳气不足，形成实寒兼阳虚证；若阳气伤甚，疾病可由实转虚，发展为虚寒证。